（）是女职工接触职业性有害因素后最常见的表现
A. 月经紊乱
B. 乳腺增生
C. 神经衰弱
D. 白带异常

正确答案：A。月经紊乱

解析：本题考查生产性毒物对女性影响。毒物对生殖系统的毒作用包括对接触者本人的生殖及其对子代发育过程的不良影响，即生殖毒性和发育毒性。生殖毒性包括对接触者生殖器官、相关内分泌系统、性周期和性行为、生育力、妊娠结局、分娩过程等方面的影响；发育毒性可表现为胎儿结构异常、发育迟缓、出生体重不足、功能缺陷、甚至死亡等。很多生产性毒物具有一定的生殖毒性和发育毒性，可以使女性月经先兆症状发生率增高、月经周期和经期异常、痛经及月经血量改变（A对BCD错）。